婚前医学检查服务的内容是指
A. 进行性卫生知识、生育知识的教育
B. 进行遗传病知识的教育
C. 对有关婚配问题提供医学意见
D. 对有关生育健康问题提供医学意见
E. 对严重遗传疾病、指定传染病和有关精神病的检查

正确答案：E。对严重遗传疾病、指定传染病和有关精神病的检查